畜肉最适宜食用的阶段是
A. 僵直
B. 后熟
C. 僵直和后熟
D. 自溶
E. 后熟和自溶

正确答案：B。后熟

解析：本题考查畜肉最适宜食用的阶段。畜肉僵直后，肉内糖原继续分解为乳酸，使pH进一步下降，肌肉结缔组织变软并具有一定的弹性，此时肉松软多汁、滋味鲜美，表面因蛋白凝固形成一层干膜，可以阻止微生物侵入，这一过程称为后熟（B对ACDE错），是畜肉最适宜食用的阶段。